下颌后牙牙槽狭窄常用
A. 鞍式桥体
B. 改良盖嵴式桥体
C. 盖嵴式桥体
D. 船底式桥体
E. 悬空式桥体

正确答案：D。船底式桥体

解析：本题考查固定桥桥体的种类及适应证。下颌后牙牙槽狭窄常用船底式桥体（D对）。船底式桥体：桥体的龈端与牙槽嵴的接触面呈船底形。特点是容易清洁，但船底式桥体颊侧和舌侧的三角形空隙容易滞留食物。鞍式桥体（A错）：龈面呈马鞍状骑跨在牙槽嵴顶上，与黏膜接触范围较大，多用于下颌后牙缺牙区牙槽嵴顶狭窄时。改良盖嵴式桥体（B错）：又称为牙槽嵴顶型桥体或者改良偏侧型桥体，将唇（颊）侧的接触区扩大至牙槽嵴顶，即前牙的舌隆突或后牙的舌、腭面延长与牙槽嵴顶接触。其特点是可以防止食物进入龈端，自洁作用好，患者感觉舒适，上、下颌固定桥都可以使用该设计。盖嵴式桥体（C错）：又称偏侧型桥体，其龈端与唇颊黏膜的一小部分呈线性接触，舌侧呈三角形开放。其特点是接触面积小，食物虽会在舌侧间隙停滞，但设计良好仍可使其自洁作用好。悬空式桥体（E错）：此种桥体的龈面与牙槽嵴顶的黏膜不接触，且留出至少3mm以上的间隙，便于食物通过而不聚集，理论上自洁作用良好，又称为卫生桥。尽管如此，其龈面仍可有牙垢和菌斑附着，自洁作用并不理想。此外，它与天然牙的形态差异大，美观性差，舌感不舒服，主要用于失牙区牙槽嵴缺损较大的后牙缺失修复。